产后三急是指
A. 呕吐、泄泻、盗汗
B. 高热、昏迷、自汗
C. 心悸、气短、抽搐
D. 尿闭、便难、冷汗
E. 下血、腹痛、心悸

正确答案：A。呕吐、泄泻、盗汗

解析：产后三急为呕吐、盗汗、泄泻，生产易损伤阴血津液，故产后应避免伤津的疾病（A对）。